男，25岁。无诱因突发心悸1小时来诊。查体：BP130/80mmHg，心率240次/分，律齐。压迫颈动脉窦后心率突然降至70次/分，律齐。该患者最可能的诊断是
A. 阵发性室上性心动过速
B. 心动过缓—心动过速综合征
C. 室性心动过速
D. 窦性心动过速
E. 心房扑动

正确答案：A。阵发性室上性心动过速

解析：患者青年男性，无诱因突发心悸，心率240次/分（正常值60～100次/分，阵发性室上性心动过速的心室率一般为150～250次/分），律齐，压迫颈动脉窦后心率突然降至70次/分（阵发性室上性心动过速压迫颈动脉窦即刺激迷走神经，可使心动过速终止），该患者最可能的诊断是阵发性室上性心动过速（A对）。心动过缓-心动过速综合征（B错）即病窦综合征（P184），是由窦房结病变导致功能减退，产生多种心律失常的综合表现。患者可在不同时间出现一种以上的心律失常，常同时合并心房自律性异常。患者出现与心动过缓有关的心、脑等脏器供血不足的症状，如发作性头晕、黑蒙、乏力等，严重者可发生晕厥。室性心动过速（P198）（C错）多发生于各种器质性心脏病患者，最常见为冠心病，特别是曾有心肌梗死的患者。窦性心动过速（P182）（D错）的心率超过100次/分，通常逐渐开始和终止，频率大多在100～150次/分之间。心房扑动（P187）（E错）往往有不稳定的倾向，可恢复窦性心律或进展为心房颤动，但亦可持续数月或数年，典型房扑的频率常为250～300次/分，体格检查可见快速的颈静脉扑动。